属于《传染病防治法》规定的乙类传染病的是
A. 鼠疫
B. 流行性感冒
C. 人感染高致病性禽流感
D. 黑热病
E. 霍乱

正确答案：C。人感染高致病性禽流感